王某，男，18岁，多饮多食多尿5年，曾有酮症酸中毒史，现在空腹血糖12.0mmol/L。应首选的治疗措施是饮食疗法加
A. 运动疗法
B. 磺脲类降糖药
C. 胰岛素
D. 二甲双胍
E. 噻唑烷二酮

正确答案：C。胰岛素

解析：糖尿病的诊断标准：“三多一少”典型症状加上随机血糖≥11.1mmol/L（200mg/dL），或空腹血浆葡萄糖（FPG）大于或等于7.0mmol/L（126mg/dL），或OGTT中2hPG大于或等于11.1mmol/L（200mg/dL）。1型糖尿病容易发生酮症酸中毒。本题患者曾有酮症酸中毒史，多饮多食多尿5年，现在空腹血糖12.0mmol/L可诊断为1型糖尿病。因为1型糖尿病患者是由于胰岛β细胞破坏，导致胰岛素绝对缺乏，所以治疗措施是饮食治疗加上胰岛素（C对）；运动疗法无论是1型还是2型糖尿病都应进行的（A错）；磺脲类降糖药、二甲双胍、噻唑烷二酮都是治疗2型糖尿病的药物（BDE错）。